非处方药的安全性评价包括
A. 制剂及其成分的研究充分，结果明确，安全性良好
B. 用药对象明确，适应症或功能主治明确
C. 作为处方药使用时的安全性
D. 涉及运动员、儿童等人群用药，应有明确的安全性指示

正确答案：C。作为处方药使用时的安全性

解析：本题考查的是处方药转换为非处方药。非处方药的安全性评价包括处方药使用时的安全性（C对）。处方药转换为非处方药的申请范围：除以下规定情况外，申请单位均可对其生产或代理的品种提出处方药转换评价为非处方药的申请：一是处于监测期内的药品；二是用与急救和其他患者不宜自我治疗疾病的药品；三是个人消费者不便自我使用的药物剂型；四是用药期间需要专业人员进行医学监护和指导的药品；五是需要在特殊条件下保存的药品；六是作用于全身的抗菌药、激素（避孕药除外）；七是含毒性中药材，且不能证明其安全性的药品；八是原料药、药用辅料、中药材、中药饮片；九是国家规定的疫苗、血液制品、药品类易制毒化学品、医疗用毒性药品、麻醉药品、精神药品和放射性药品，以及其他特殊管理的药品；十是其他不符合非处方药要求的药品。申请药品应符合“应用安全、疗效确切、质量稳定、使用方便”的基本原则，同时，药品的各种属性均应体现“适于自我药疗”。基本要求包括：一是制剂或其成分应已在我国上市，并经过长期临床使用，同时应用比较广泛、有足够的使用人数；二是制剂及其成分的研究应充分，结果应明确，安全性良好（A错）；三是制剂及其成分具有法定质量标准，质量可控、稳定；四是用法用量、疗程明确，疗效确切；五是药品适应症应符合非处方药适应症范围，适于自我药疗；六是涉及小儿、孕妇等特殊人群用药，应有明确的用药指示（D错）；七是给药途径、剂型、剂量、规格、用药时间、贮存、包装、标签及说明书等特性均适于自我药疗需求。处方药转换为非处方药时，需要进行安全性以及有效性评价。安全性及有效性评价：非处方药的安全性评价包括三方面的内容：一是指作为处方药品时的安全性；二是当药品成为非处方药后广泛使用时出现滥用、误用情况下的安全性；三是当处于消费者进行自我诊断、自我药疗情况下的药品安全性。非处方药有效性是指在足够的使用指示及不安全使用警告的条件下，用于绝大多数目标人群中能够产生合理、有效的预期药理作用，并对其所治疗的类型产生明显的解除作用。除用于日常营养补充的维生素、矿物质等外，非处方药的有效性应具有如下特点：一是用药对象明确，适应症或功能主治明确（B错）；二是绝大多数适用对象正确使用后能产生预期的作用；三是用法用量明确；四是不需要与其他药物联合使用（辅助治疗药品除外）；五是疗效确切，用药后的效果明显或明确，患者一般可以自我感知。